善治梅毒，具有解毒除湿利关节功能的药物是
A. 垂盆草
B. 鱼腥草
C. 大青叶
D. 土茯苓
E. 蒲公英

正确答案：D。土茯苓

解析：土茯苓的应用于杨梅毒疮，肢体拘挛。本品甘淡，解毒利湿，通利关节，又兼解汞毒，故对梅毒或因梅毒服汞剂中毒而致肢体拘挛、筋骨疼痛者疗效尤佳，为治疗梅毒解毒除湿利关节的要药（D对）。垂盆草的应用于黄疸；痈肿疮疡，喉痛，蛇伤，烫伤（A错）。鱼腥草的应用于肺痈吐脓，肺热咳嗽；热毒疮疡；湿热淋证的功能（B错）。大青叶的应用于热入营血，温毒发斑；喉痹口疮，痄腮丹毒（C错）。蒲公英的应用于痈肿疔毒，乳痈内痈；热淋涩痛，湿热黄疸（E错）。梅毒的常用药有土茯苓、轻粉、大风子、升药、水银。